不参与构成股环
A. 腹股沟韧带
B. 耻骨梳韧带
C. 腔隙韧带
D. 股静脉鞘
E. 反转韧带

正确答案：E。反转韧带

解析：股环的内侧界为腔隙韧带（C对），后界为耻骨梳韧带（B对），前界为腹股沟韧带（A对），外侧界为股静脉内侧的纤维隔（即股静脉鞘）（D对，故E为本题正确答案）。